根据药典等标准，为适应治疗或预防的需要而制备的药物应用形式的具体品种称为
A. 药物剂型
B. 药物制剂
C. 药剂学
D. 调剂学
E. 方剂

正确答案：B。药物制剂

解析：本题考查药物的剂型与制剂。根据药典等标准，为适应治疗或预防的需要而制备的药物应用形式的具体品种称为药物制剂（B对）。药物制剂是指根据药典或药政管理部门批准的标准、为适应治疗或预防的需要而制成的药物应用形式的具体品种。药物是在临床应用之前，为了充分发挥药效、减少毒副作用、便于运输、使用与保存，将药物制成适合于医疗或预防应用的形式。这种适合于疾病的诊断、治疗或预防的需要而制备的不同给药形式，我们称其为药物剂型（A错）。药剂学（C错）是研究药物配制理论、生产技术以及质量控制合理利用等内容的综合性应用技术学科。调剂学（D错）是研究方剂的调制技术、理论和应用的科学。方剂（E错）是指按医师处方专为某一患者调制的，并明确规定用法用量的药剂。